某心理咨询师在超级市场遇见一位他的患者正与其热人一起购物，这位治疗师故意未理睬该患者。心理咨询师遵循的心理治疗原则是
A. 保密原则
B. 回避原则
C. 灵活原则
D. 真诚原则
E. 中立原则

正确答案：A。保密原则